霍乱吐泻“米泔水”样物质是由于泻吐物中
A. 含大量粘液
B. 含大量脱落上皮细胞
C. 含大量胃肠粘膜
D. 缺乏胃酸
E. 缺乏胆汁

正确答案：E。缺乏胆汁

解析：霍乱肠毒素能够刺激肠黏膜隐窝细胞过度分泌水、氯化物及碳酸氢盐，同时抑制肠绒毛细胞的正常吸收，剧烈的水样腹泻，还能促使肠黏膜杯状细胞分泌粘液增多，使腹泻水样便中含大量黏液，且由于失水，胆汁的分泌减少，因而粪便呈现“米泔水”样（E对）。